男，30岁，约一年时间孤僻、寡言，近期由于被上级批评后出现失眠，不上班并紧闭门窗，声称有人监视自己，在家中不敢谈话，说家中已被安装窃听器，公安局也要逮捕自己，不吃妻子做的饭食，认为妻子已同他人合伙在饭菜中放了毒药。因此殴打妻子。除药物治疗外要注意的是
A. 说服病人放弃怀疑
B. 外出旅行、疗养
C. 防止发生意外
D. 更换工作单位
E. 请上级、同事改变对病人的态度

正确答案：C。防止发生意外

解析：青年男性患者，既往约一年时间孤僻、寡言，近期出现失眠，不上班并紧闭门窗，声称有人监视自己，在家中不敢谈话，说家中已被安装窃听器，公安局也要逮捕自己，不吃妻子做的饭食，认为妻子已同他人合伙在饭菜中放了毒药（患者认为自己被某些人或某些组织进行迫害，投毒、监视），最可能的诊断为精神分裂症偏执型。精神分裂偏执型表现为开始敏感多疑，逐渐发展为妄想并有泛化趋势。精神分裂的治疗包括药物治疗和心理社会干预。心理社会干预理想状态患是，患者恢复了由于疾病所致的精力下降与体力下降，可减少外出旅行、疗养（B错），要达到并保持良好的健康状态，恢复原有的工作或学习能力；不要更换工作单位（D错），注意重建恰当稳定的人际关系；不要请上级、同事改变对病人的态度（E错），注意提高患者和监护人对疾病的理解；要求家庭做到能接受患者的精神症状的存在，不要说服病人放弃怀疑（A错）。应消除可能诱发精神病的应急源，防止意外的发生（C对）。